颞肌的起始部位为
A. 上颌骨颧突及颧弓下缘的前2/3
B. 颞窝及颞深筋膜深面
C. 腭骨锥突及上颌结节
D. 蝶骨大翼的颞下面，颞下嵴及翼外板的外侧面
E. 上颌骨的眶下缘及额突

正确答案：B。颞窝及颞深筋膜深面

解析：本题考查咀嚼肌、颈部肌及口颌系统肌链。起于颞窝及颞深筋膜的深面（B对），通过颧弓深面，止于喙突及下颌支前缘直至第三磨牙远中。功能：上提下颌骨，也参与侧方运动。